急性盆腔炎湿热瘀结证用
A. 仙方活命饮
B. 五味消毒饮
C. 银甲丸
D. 清营汤
E. 理中汤

正确答案：A。仙方活命饮

解析：急性盆腔炎湿热瘀结证，治以清热利湿，化瘀止痛 用仙方活命饮，仙方活命饮出自《校注妇人良方》，具有清热解毒，消肿溃坚，活血止痛的功效，使湿热去，瘀血行，则热退痛缓，疾病可愈（A对）。急性盆腔炎热毒炽盛证用五味消毒饮（B错）。慢性盆腔炎湿热瘀结证用银甲丸（C错）。急性盆腔炎热毒炽盛证热毒已入营血用清营汤（D错）。理中汤不用于治疗盆腔炎（E错）。